对维持血管内外水平衡有重要作用的是
A. 血浆晶体渗透压
B. 血浆
C. 血浆胶体渗透压
D. 组织液
E. 组织液胶体渗透压

正确答案：C。血浆胶体渗透压